皮肤病糜烂，稍有渗液而无红热之证，外治应首选
A. 金黄散
B. 玉露散
C. 桃花散
D. 三石散
E. 青黛散

正确答案：D。三石散

解析：三石散由炉甘石、石膏、赤石脂组成。属于清热收涩药，具有清热止痒，收涩生肌的功效，适用于一切皮肤病急性或亚急性皮炎而渗夜不多，无红热者（D对）。金黄散（A错）、玉露散（B错）具有箍集围聚、收束疮毒的功效，可用于红肿热痛明显的阳证疮疡。桃花散（C错）具有收涩凝血的作用，适用于溃疡出血、创伤出血证。青黛散（E错）清热止痒的作用较强，用于皮肤病大片潮红红疹而无渗夜者。